眩晕、头痛、乏力、困倦、失眠、痉挛等属于
A. 胃肠道反应
B. 过敏反应
C. 血液系统反应
D. 肝功能受损
E. 中枢神经系统反应

正确答案：E。中枢神经系统反应